开闭口运动正常的标志中，不恰当的一项是
A. 双侧髁突运动均匀一致
B. 关节内无响声，无弹跳现象
C. 颌面部无痛
D. 下颌颏部运动不偏斜，无前伸动作
E. 开口度为20mm以上

正确答案：E。开口度为20mm以上

解析：开闭口运动正常的标志：双侧髁突运动均匀一致；关节内无响声，无弹跳现象；颌面部无痛，下颌颏部运动不偏斜，无前伸动作；开口度为40mm以上。掌握“下颌运动的形式、范围及意义”知识点。